适用于皮肤松弛部位腧穴的进针方法是
A. 单手进针法
B. 舒张进针法
C. 提捏进针法
D. 夹持进针法
E. 指切进针法

正确答案：B。舒张进针法

解析：舒张进针法主要用于皮肤松弛部位的腧穴（B对）。单手进针法多用于较短的毫针（A错）。提捏进针法主要用于皮肉浅薄部位的腧穴（C错）。夹持进针法主要用于长针的进针（D错）。指切进针法主要用于短针的进针（E错）。